下列哪项不符合G蛋白的特点
A. 又称鸟苷三磷酸结合蛋白
B. 特点是结合的核苷酸为GTP时处于活化
C. 可将结合的GTP水解为GDP
D. 亦称GTP结合蛋白
E. G蛋白主要有三大类

正确答案：E。G蛋白主要有三大类

解析：有一类重要的信号通路开关，即鸟苷酸结合蛋白，简称G蛋白，亦称GTP结合蛋白。G蛋白主要有两大类：介导七跨膜受体信号转导的异源三聚体G蛋白和低分子量G蛋白。G蛋白的共同特点是结合的核苷酸为GTP时处于活化形式，作用于下游分子使相应信号途径开放。这些G蛋白自身均具有GTP酶活性，可将结合的GTP水解为GDP，回到非活化状态，使信号途径关闭。掌握“各信号分子及转导机制”知识点。